使声门开大的肌肉是
A. 环甲肌
B. 环杓后肌
C. 环杓侧肌
D. 甲杓肌
E. 杓横肌

正确答案：B。环杓后肌

解析：环杓后肌使声门开大（B对）。